大多数化学致癌物在化学结构上最主要的特点是
A. 亲核的活性代谢产物
B. 亲电子的活性代谢产物
C. 自由基形式的代谢产物
D. 环氧化物
E. 含亲水集团的物质

正确答案：B。亲电子的活性代谢产物